以下疾病容易在年轻，或者抵抗力强的患者中出现的是
A. 急性根尖周炎
B. 慢性根尖周炎
C. 牙髓坏死
D. 化脓性骨髓炎
E. 致密性骨炎

正确答案：E。致密性骨炎

解析：本题考查急慢性根尖周炎。以下疾病容易在年轻，或者抵抗力强的患者中出现的是致密性骨炎（E对）。部分年轻患者，抵抗力强，在轻微低毒刺激下，炎症缓解，根尖部分出现恢复性的表现，称为致密性骨炎。